胚胎第4周，额鼻突的末端被两个凹陷分成三个突起，中间的称为中鼻突，两侧的称为
A. 球状突
B. 侧鼻突
C. 上颌突
D. 下颌突
E. 额鼻突

正确答案：B。侧鼻突

解析：胚胎第4周末，额鼻突的末端被两个凹陷分别分成三个突起，中间的称为中鼻突，两侧的称为侧鼻突。掌握“面部的发育”知识点。